根据充分病因-组分病因模型，若X是某疾病的病因之一，但并非所有暴露于它的人都会发病，说明X肯定
A. 是充分病因
B. 是必要病因
C. 是非必要非充分病因
D. 不是充分病因
E. 不是必要病因

正确答案：D。不是充分病因

解析：本题考查充分病因-组分病因模型的相关内容。充分病因是疾病发生的充分条件，其形成就等于疾病的发生。本题中若X是某疾病的病因之一，但并非所有暴露于它的人都会发病，说明X肯定不是充分病因（D对ABCE错）。